下列对“双侧完全性唇裂”的理解正确的是
A. 双侧裂隙均未裂至鼻底
B. 一侧完全裂，另一侧不完全裂
C. 下方的肌层未能联合或错位联合
D. 合并双侧牙槽嵴裂
E. 双侧上唇至鼻底完全裂开

正确答案：E。双侧上唇至鼻底完全裂开

解析：双侧唇裂：双侧不完全性唇裂（双侧裂隙均未裂至鼻底）；双侧完全性唇裂（双侧上唇至鼻底完全裂开）；双侧混合性唇裂（一侧完全裂，另一侧不完全裂）掌握“唇裂”知识点。